主要通过阻滞钙通道发挥抗心律失常作用的药物是
A. 普鲁卡因胺
B. 利多卡因
C. 普罗帕酮
D. 维拉帕米
E. 奎尼丁

正确答案：D。维拉帕米